某女，26岁。每至经期出现腹痛，痛势绵绵，月经色淡，量少，伴面色苍白，倦怠无力，舌淡，脉细弱。治疗除三阴交关元足三里外，宜选取
A. 太冲、血海
B. 关元、归来
C. 太冲、气海
D. 太溪、肾俞
E. 气海、脾俞

正确答案：E。气海、脾俞

解析：患者每至经期出现腹痛，痛势绵绵可辨病为痛经，伴有月经色淡，量少，伴面色苍白，倦怠无力，舌淡，脉细弱可辨证为气血不足证，配以气海、脾俞（E对）。气滞血瘀配太冲、血海（A错）。寒凝血瘀配关元、归来（B错）。太冲治疗气滞症状，气海治疗气虚症状（C错）。痛经虚证若肾气亏损配太溪、肾俞（D错）。